容易闻及二尖瓣杂音的体位是
A. 坐位
B. 立位
C. 平卧位
D. 右侧卧位
E. 左侧卧位

正确答案：E。左侧卧位

解析：容易闻及二尖瓣杂音的体位是左侧卧位（E对BCD错），因为二尖瓣杂音常向左腋下传导。坐位（A错）为容易闻及主动脉瓣杂音的体位。